龟鹿二仙膏的功能是
A. 温肾敛肺
B. 温肾益精
C. 温肾纳气
D. 滋阴清热
E. 温补气血

正确答案：B。温肾益精